下列关于劣药的说法不正确的是
A. 药品成分的含量不符合国家药品标准的为劣药
B. 药品所含成分与国家药品标准规定的成分不符的为实药
C. 不注明生产批号的药品按照劣药论处
D. 更改生产批号的药品按照劣药论处
E. 直接接触药品的包装材料和容器未经批准的药品按照劣药论处

正确答案：B。药品所含成分与国家药品标准规定的成分不符的为实药

解析：本题考查劣药的定义。劣药，是指药品成分含量不符合国家药品标准规定的药品（A对）。《药品管理法》规定，有下列情形之一的药品按劣药论处：①未标明有效期或者更改有效期的；②不注明或者更改生产批号的（CD对）；⑧超过有效期的；④直接接触药品的包装材料和容器未经批准的（E对）；⑤擅自添加着色剂、防腐剂、香料、矫味剂及辅料的；⑥其他不符合药品标准规定的”（B错，为本题正确答案）。